能降低血压但伴有反射性心率加快，易导致心肌缺血的药物是
A. 硝苯地平
B. 卡托普利
C. 普萘洛尔
D. 氯沙坦
E. 氢氯噻嗪

正确答案：A。硝苯地平